脊髓半横断（Brown-Seguard）综合征常见于
A. 格兰巴雷综合征
B. 急性脊髓炎
C. 急性硬脊膜外脓肿
D. 脊髓髓外肿瘤
E. 脊髄空洞症

正确答案：D。脊髓髓外肿瘤

解析：脊髓半横断（现称脊髓半切综合征）是指脊髓病损等原因引起病损平面以下同侧肢体上运动神经元瘫痪，深感觉消失、精细触觉障碍，血管舒缩功能障碍，对侧肢体痛温觉消失，双侧触觉保留的临床综合征。常见病因有脊髓外压迫和脊髓内病变，脊髓外压迫主要见于脊髓髓外肿瘤（D对）。格兰-巴雷综合征（A错）主要损害部位在脊神经根和周围神经，无脊髓损害（P350）。急性脊髓炎（B错）引起的是急性横贯性脊髓病变（P322）。急性硬脊膜外脓肿（C错）由于病变部位在硬膜外，脊髓受到硬脊膜的阻挡，脊髓受压较轻，脊髓半切综合征不常见（P324）。脊髄空洞症（E错）病变部位多发生在脊髓灰质部分，临床表现为受累的脊髓节段神经损害症状，以痛、温觉减退与消失、而深感觉保存的分离性感觉障碍为特点（P329-P330），不表现为脊髓半切综合征。